散发性先天性甲状腺功能减低症病因中不包括
A. 甲状腺不发育或发育不全
B. 甲状腺素合成障碍
C. 促甲状腺激素缺乏
D. 甲状腺或靶器官反应低下
E. 碘缺乏

正确答案：E。碘缺乏

解析：散发性先天性甲低的病因包括：1.甲状腺不发育或发育不全（A对）；2.甲状腺素合成障碍（B对）；3. 促甲状腺激素缺乏（C对）；4.甲状腺或靶器官反应低下（D对）；5.母亲服用抗甲状腺药物或母亲患自身免疫性疾病存在TSH抗体。碘缺乏（八版内科学P683）（E错，为本题正确答案），是地方性甲状腺肿的最常见原因，并不是散发性先天性甲状腺功能减低症的病因。